下列除哪项外，均是虚寒证的临床表现
A. 畏寒喜暖
B. 口淡不渴
C. 脉沉而紧
D. 小便清长
E. 大便溏薄

正确答案：C。脉沉而紧

解析：本题考查虚寒证的临床表现，其是由于体内阳气虚衰所致，阳气的推动、气化作用不足，故精神不振，面色淡白，脉微或沉迟无力；阳气温煦不足，故畏寒喜暖（A错），小便清长（D错），大便溏薄（E错），寒为阴邪，寒不消水，不耗伤津液，故口淡不渴（B错）。